关于散剂质量要求的说法，错误的是
A. 除另有规定外，内服散剂应为细粉
B. 除另有规定外，中药散剂水分不得过9.0%
C. 制备含有毒性药的散剂，应采用配研法混匀并过筛
D. 除另有规定外，眼用散剂应为最细粉
E. 用于烧伤治疗的散剂如为非无菌制剂，应在标签上标明“非无菌制剂”

正确答案：D。除另有规定外，眼用散剂应为最细粉

解析：本题考查散剂的质量要求。（三）质量要求（1）供制备散剂的原料药均应粉碎。除另有规定外，内服散剂应为细粉（A对）；儿科及局部用散剂应为最细粉；眼用散剂应为极细粉（D错，为本题正确答案），且应无菌。中药散剂照《中国药典》水分测定法测定，除另有规定外，不得过9.0%（B对）。制备含有毒性药、贵重药或药物剂量小的散剂时，应采用配研法混匀并过筛（C对）。散剂用于烧伤治疗，如为非无菌制剂的，应在标签上标明“非无菌制剂”；产品说明书中应注明“本品为非无菌制剂”（E对）。